散瞳药阿托品滴眼液的禁用人群是
A. 青光眼患者
B. 眼底检查者
C. 虹膜睫状体炎患者
D. 睫状肌麻痹患者
E. 角膜炎患者

正确答案：A。青光眼患者

解析：本题考查阿托品的禁忌症。阿托品类散瞳药对眼压异常或窄前房角、浅前房的患者应用后可使眼压明显升高，有激发青光眼急性发作的危险，因此青光眼患者（A对）不用阿托品滴眼。